下列疾病中哪项不会出现血液性缺氧
A. 高铁血红蛋白血症
B. 血红蛋白病
C. 煤气中毒
D. 肺炎
E. 严重贫血

正确答案：D。肺炎

解析：由于血红蛋白含量减少，或血红蛋白性质改变，使血液携氧能力下降或与血红蛋白结合的氧不易释放引起的缺氧，称为血液性缺氧。引起其缺氧的原因有：①血红蛋白含量减少，主要见于各种原因引起的严重贫血（E对）。②煤气中毒（C对）。③高铁血红蛋白血症（A对）。④血红蛋白与氧的亲和力异常增高，从而使组织缺氧，如血红蛋白病（B对）。肺炎（D错，为本题正确答案）是引起乏氧性缺氧的原因。